男，60岁。腹胀6天，伴轻度腹痛，偶有呕吐。近4天肛门停止排气排便，半个月曾患腹膜炎。查体：全腹胀，肠鸣音消失。血钾3.1mmol/L。最可能的诊断是
A. 麻痹性肠梗阻
B. 痉挛性肠梗阻
C. 血运性肠梗阻
D. 机械性肠梗阻
E. 假性肠梗阻

正确答案：A。麻痹性肠梗阻

解析：患者腹痛，腹胀，呕吐，停止排气排便，曾患腹膜炎，最可能的诊断是麻痹性肠梗阻（A对）。痉挛性肠梗阻（B错）较为少见，可发生于急性肠炎、肠道功能紊乱或慢性铅中毒病人。血运性肠梗阻（C错）由于肠系膜血管栓塞或血栓形成，使肠管血运障碍，肠失去蠕动能力。机械性肠梗阻（D错）系各种原因引起肠腔狭小或不通，致使肠内容物不能通过。